关于丙戊酸钠，下列叙述哪项不正确
A. 为广谱抗癫痫药
B. 其抗癫痫作用与GABA有关
C. 对小发作优于乙琥胺，为治疗小发作的首选药物
D. 对大发作疗效不及苯妥英钠
E. 对精神运动性发作疗效近似卡马西平

正确答案：C。对小发作优于乙琥胺，为治疗小发作的首选药物

解析：丙戊酸钠为广谱的抗癫痫药（A对），其抗癫痫的作用机制为抑制脑内GABA转氨酶（B对），减慢GABA的代谢，使脑内GABA含量升高，提高突触后膜对GABA的反应性，增强GABA能神经突触后抑制，从而抑制病灶异常放电的扩散，临床上对各型癫痫都有一定的疗效，对大发作的疗效不及苯妥英钠（D对）、苯巴比妥，对小发作疗效优于乙琥胺，但其肝毒性大，一般不作首选（C错，为本题正确答案），对精神运动性发作疗效与卡马西平相似（E对）。